下列对血的生成和运行论述中哪一项欠妥
A. 精能化血
B. 肝能藏血
C. 脾能生血
D. 肾能裹血
E. 心能行血

正确答案：D。肾能裹血

解析：该题考查血的生成和运行。肾藏精，精生髓，髓充于骨，可化为血，故肾能裹血论述欠妥（D错，为本题的正确答案）。精能化血，是血液生成的来源之一（A对）。脾为气血生化之源，故脾能生血（C对）。肝主藏血，具有贮藏血液，调节血量和防止出血的功能，故肝能藏血（B对）。心主血脉，指心气推动血液运行于脉中，故心能行血（E对）